具有较大脂溶性，口服生物利用度为80%～90%，半衰期为14～22小时，每天仅需给药一次的选择性β₁受体阻断药是
A. 普萘洛尔
B. 噻吗洛尔
C. 艾司洛尔
D. 倍他洛尔
E. 吲哚洛尔

正确答案：D。倍他洛尔

解析：本题考查选择性β₁受体阻断药。选择性β₁受体阻断药倍他洛尔（D对）脂溶性较大，口服后在胃肠道易于吸收，生物利用度为80%～90%，无首关效应，半衰期为14～22小时，每天仅需给药一次。艾司洛尔（C错）是选择性β₁受体阻断药，在体内可迅速被红细胞内酯酶水解而失活；t1/2约9.2分钟；静脉给药6～10分钟作用最大。普萘洛尔（A错）、噻吗洛尔（B错）、吲哚洛尔（E错）是非选择性β受体阻断药。